男孩，10岁。眼睑浮肿伴少尿，血尿3天，3周前曾患皮肤脓包。最主要的治疗
A. 限盐，利尿
B. 糖皮质激素
C. 环磷酰胺
D. 硝苯地平
E. 甲氨蝶呤

正确答案：A。限盐，利尿

解析：该患者患病3周前曾患皮肤脓包，为前驱感染，发病后眼睑浮肿伴少尿，血尿3天，可诊断为急性肾小球肾炎。急性肾小球肾炎的治疗无特异性，以休息、限盐、利尿为主（A对）。硝苯地平主要用于降血压（D错）。糖皮质激素（B错）、环磷酰胺（C错）、甲氨蝶呤（E错）不用于治疗儿童的肾小球肾炎。